患儿，5岁半，右下后牙肿痛2日，检查：右下第二乳磨牙冠大部分破坏，龋洞较深，叩（+），松动Ⅱ度，颊侧牙龈处有0.5mm×0.5mm脓肿，X线片显示根吸收达根长1/3，根分歧有低密度阴影，右下第一恒磨牙根形成2/3，上方骨板消失。如果治疗右下第二乳磨牙后仍然松动，症状不缓解，应做的处理是
A. 开放，定期换药
B. 完善根管治疗
C. 拔除做功能保持器
D. 拔除，做远中导板保持器
E. 拔除，待第一恒磨牙萌出后矫治

正确答案：D。拔除，做远中导板保持器

解析：本题考查乳牙牙髓病及根尖周病诊断及治疗。远中导板保持器（D对）适应证：适于第二乳磨牙早失、第一恒磨牙尚未萌出或萌出不足。